母乳喂养儿粪便中主要的细菌是
A. 大肠杆菌
B. 肠链球菌
C. 副大肠杆菌
D. 变形杆菌
E. 乳酸杆菌

正确答案：E。乳酸杆菌

解析：母乳喂养儿粪便中主要的细菌是乳酸杆菌的原因是：人乳的补体及双歧因子含量远远多于牛乳。双歧因子促乳酸杆菌生长（E对），使肠道pH达4.0～5.0，抑制大肠埃希菌、痢疾杆菌、酵母菌生长。